某女，55岁，面色萎黄，唇甲色淡，头晕眼花，脉细。医师辨证后处方为四物合剂。若患者又兼脾胃气虚，症见胃纳不佳、食少便溏，宜加服的成药是
A. 青娥丸
B. 右归丸
C. 参苏丸
D. 四君子丸
E. 桂附地黄丸

正确答案：D。四君子丸

解析：本题考查的是四君子丸的主治。面色萎黄，唇甲色淡，头晕眼花，脉细。医师辨证后处方为四物合剂。若患者又兼脾胃气虚，症见胃纳不佳、食少便溏，宜加服的成药是四君子丸（D对）。四君子丸：【主治】脾胃气虚，胃纳不佳，食少便溏。青娥丸（A错）：【主治】肾虚腰痛，起坐不利，膝软乏力。右归丸（B错）：【主治】肾阳不足，命门火衰，腰膝酸冷，精神不振，怯寒畏冷，阳痿遗精，大便溏薄，尿频而清。参苏丸（C错）：【主治】身体虚弱，感受风寒所致的感冒，症见恶寒发热、头痛鼻塞、咳嗽痰多、胸闷呕逆、乏力气短。桂附地黄丸（E错）：【主治】肾阳不足，腰膝酸冷，肢体浮肿，小便不利或反多，痰饮喘咳，消渴。